中国药典的简写为
A. BP
B. ChP
C. JP
D. pH.Eur.
E. USP

正确答案：B。ChP

解析：本题考查药典。中国药典的简写为ChP（B对）。《中国药典》缩写为ChP；BP（A错）是英国药典的缩写；JP（C错）是日本药典的缩写；Ph.Eur.（D错）是欧洲药典的缩写；USP（E错）是美国药典的缩写。